通过直接作用M胆碱受体，产生拟胆碱活性的药物是
A. 硝酸毛果芸香碱
B. 溴新斯的明
C. 溴丙胺太林
D. 氯化琥珀胆碱
E. 泮库溴铵

正确答案：A。硝酸毛果芸香碱